下颌游离端局部义齿基托后缘应位于
A. 末端人工牙远中
B. 磨牙后垫前方
C. 磨牙后垫前缘
D. 磨牙后垫1/2～2/3
E. 磨牙后垫后缘

正确答案：D。磨牙后垫1/2～2/3

解析：本题考查局部义齿人工牙及基托。上颌后牙游离端义齿基托后缘应伸展到翼上颌切迹，远中颊侧应盖过上颌结节，后缘中部应到硬软腭交界处稍后的软腭上。下颌基托后缘应覆盖磨牙后垫的1/2～2/3 （D对）。基托边缘不宜伸展到组织倒凹区，以免影响义齿就位或就位时擦伤倒凹以上突出部位的软组织。